关于药物制剂规格的说法，错误的是
A. 阿司匹林规格为0.1g，是指平均片重为0.1g
B. 药物制剂的规格是指每一单位制剂中含有主药的重量（或效价）或含量或（%）装量
C. 葡萄糖酸钙口服溶液规格为10%，是指每100ml口服溶液中含葡萄糖酸钙10g
D. 注射用胰蛋白酶规格为5万单位，是指每支注射剂中含胰蛋白酶5万单位
E. 硫酸庆大霉素注射液规格为1ml：20mg(2万单位），是指每支注射液的装量为1ml、含庆大霉素20mg(2万单位）

正确答案：A。阿司匹林规格为0.1g，是指平均片重为0.1g

解析：本题考查药物制剂规格。关于药物制剂规格的说法，错误的是阿司匹林规格为0.1g，是指平均片重为0.1g（A错，为本题正确答案）。制剂的规格，系指每一支、片或其他每一个单位制剂中含有主药的重量（或效价）或含量（%）或装量（B对）。例如，阿司匹林片“规格0.1g”系指每片中含阿司匹林0.1g；注射用糜蛋白酶“规格800单位”系指每支注射剂含糜蛋白酶800单位；硫酸庆大霉素注射液规格为1ml：20mg(2万单位），是指每支注射液的装量为1ml、含庆大霉素20mg(2万单位）（E对）；葡萄糖酸钙口服溶液规格为10%，是指每100ml口服溶液中含葡萄糖酸钙10g（C对）；注射用胰蛋白酶规格为5万单位，是指每支注射剂中含胰蛋白酶5万单位（D对）。